甲型强心苷甾体母核C-17的侧链是
A. 葡萄糖
B. 鼠李糖
C. 六元不饱和内酯环
D. 五元不饱和内酯环
E. 羧基

正确答案：D。五元不饱和内酯环

解析：本题考查的是强心苷元的结构。甲型强心苷甾体母核C-17的侧链是五元不饱和内酯环（D对）。根据C-17侧链不饱和内酯环的不同，将强心苷元分为两类。①甲型强心苷元（强心甾烯类）：甾体母核的C-17侧链为五元不饱和内酯环，基本母核称为强心甾，由23个碳原子构成。在已知的强心苷元中，大多属于此类。②乙型强心苷元（海葱甾二烯或蟾蜍甾二烯类）：甾体母核的C-17侧链为六元不饱和内酯环（C错），基本母核为海葱甾或蟾蜍甾。自然界中仅少数苷元属此类，如中药蟾蜍中的强心成分蟾毒配基类。葡萄糖（A错）、鼠李糖（B错）可作为强心苷中糖的部分，与强心苷元相连接。羧基（E错）为的官能团取代基，不能作为强心苷甾体母核的C-17侧链。